鼓室
A. 为1个规则的含气小腔
B. 前壁为颈静脉壁
C. 后壁上有蜗窗
D. 内侧壁上有面神经管凸
E. 下壁为颈动脉壁

正确答案：D。内侧壁上有面神经管凸

解析：鼓室是颞骨岩部内含气的不规则小腔（A错）。鼓室下壁为颈静脉壁（E错）。前壁为颈动脉壁（B错）。内侧壁中部有圆形的隆起，称岬，岬的后下方有蜗窗（C错）。内侧壁的前庭窗的后上方有一弓形隆起，称面神经管凸（D对），内藏面神经。